关于恒牙的萌出，下列说法错误的是
A. 2岁半左右至6～7岁期间，儿童口腔中仅有乳牙存在，称为乳牙（牙合）期
B. 约6～7岁至12～13岁，称为替牙（牙合）期
C. 12～13岁以后，称为恒牙（牙合）期
D. 6岁左右，六龄牙位于第二乳磨牙的近中萌出
E. 一般按照顺序，左右成对萌出

正确答案：D。6岁左右，六龄牙位于第二乳磨牙的近中萌出

解析：本题考查牙的萌出、更替及牙体解剖名词、标志。恒牙的萌出及乳恒牙更替：儿童于6岁左右，在第二乳磨牙的远中，第一恒磨牙开始萌出，通常称为“六龄牙”（D错，为本题正确答案）；2岁半左右至6～7岁期间，儿童口腔中仅有乳牙存在，称为乳牙（牙合）期（A对）；约6～7岁至12～13岁，恒牙逐渐替换乳牙，此段时期称为替牙（牙合）期（B对）。12～13岁以后，口腔中全部为恒牙，称为恒牙（牙合）期（C对）。牙萌出的规律为：①在一定时期内，按照一定的顺序，左右成对萌出（E对）；②一般情况下，下颌牙的萌出较上颌同名牙略早；③女性同名牙的萌出略早于男性。